诊疗过程中始终以患者为中心的是
A. 最优化原则
B. 患者至上原则
C. 知情同意原则
D. 保密守信原则
E. 酌情隐瞒原则

正确答案：B。患者至上原则

解析：本题考查临床诊疗和临床诊断的伦理。患者至上原则（B对）是指医务人员在诊疗过程中始终以患者为中心，并把患者的利益放在首位。